某镇卫生院3名医务人员违反《献血法》规定，将不符合国家规定标准的血液用于患者，由于患者家属及时发现，经治医师采取果断措施，幸好未给受血者健康造成损害。根据《献血法》规定，当地县卫生局应对3名医务人员给予的行政处理是
A. 责令改正
B. 警告
C. 罚款1万元以下
D. 暂停职业活动6个月以上1年以下
E. 吊销其医师职业证书

正确答案：A。责令改正

解析：《献血法》规定，医疗机构的医务人员违反规定，将不符合国家规定标准的血液用于患者的，由县级以上地方人民政府卫生行政部门责令改正（A对）；给患者健康造成损害的，应当依法赔偿，对直接负责的主管人员和其他直接责任人员，依法给予行政处分；构成犯罪的，依法追究刑事责任。该镇卫生院3名医务人员违反《献血法》规定，将不符合国家规定标准的血液用于患者，未给受血者健康造成损害，未导致情节严重、构成犯罪，当地县卫生局应对3名医务人员给予的行政处理是责令改正（A对）。